职业性噪声聋的诊断原则
A. 有明确的职业噪声接触史
B. 排除其他致聋原因
C. 纯音测定为感音性耳聋
D. 以上都是
E. 以上都不是

正确答案：D。以上都是

解析：本题考查职业性噪声聋的诊断原则。职业性噪声聋是指劳动者在工作过程中，由于长期接触噪声而发生的一种渐进性的感音性听觉损伤。职业性噪声聋的诊断需要有明确的噪声接触职业史，有自觉听力损失或耳鸣等其他症状，听力曲线为感音性耳聋，结合动态职业健康检查资料和现场卫生学调查，排除其他原因所致听力损失，方可进行诊断（D对ABCE错）。